患者，男，50岁。肝硬化腹水，腹大坚满，脘闷纳呆，大便溏，小便不利，舌苔白腻，脉弦缓。其治法是
A. 运脾利湿，化气行水
B. 疏肝理气，攻下逐水
C. 活血化痰，利水消肿
D. 调脾行气，清热利湿
E. 温补肾阳，通络利水

正确答案：A。运脾利湿，化气行水

解析：脾阳不振，寒湿停聚，水蓄不行，故腹大坚满；寒湿相搏，中阳不运，故脘闷纳呆；寒湿困脾，兼伤肾阳，水液不行故大便溏，小便不利；舌苔白腻，脉弦缓均为寒湿困脾之侯，治法为运脾利湿，化气行水（A对）。疏肝理气，攻下逐水（B错）用于治疗气滞湿阻证。活血化痰，利水消肿（C错）用于治疗肝脾血瘀证。调脾行气，清热利湿（D错）用于治疗湿热蕴脾证。温补肾阳，通络利水（E错）用于治疗脾肾阳虚证。